下列药物服用方法正确的是
A. 呋塞米，睡前服用
B. 多潘立酮，餐前服用
C. 奥利司他，空腹服用
D. 阿卡波糖，餐后服用
E. 阿仑膦酸钠，餐后服用

正确答案：B。多潘立酮，餐前服用

解析：本题考查一般药品适宜的服用时间。多潘立酮，餐前服用（B对）。多潘立酮为促胃动力药，餐前服用帮助消化。呋塞米为利尿药，宜清晨服用（A错）。奥利司他进餐时服用（C错）。阿卡波糖为降糖药，宜餐中服用（D错）。阿仑膦酸钠宜餐前服用（E错）。